某药品经营批发企业，有少量的销后退回药品，对该批药品的正确处理有
A. 凭销售部开具的退货凭证收货
B. 做好退货记录，存放药品库红色区
C. 做好退货记录，存放药品库黄色区
D. 经验收合格，存放药品库绿色
E. 退货记录应保存3年

正确答案：A、C、D、E。凭销售部开具的退货凭证收货；做好退货记录，存放药品库黄色区；经验收合格，存放药品库绿色；退货记录应保存3年